某女，52岁。患痹证多年，症见肢体关节疼痛，入夜尤甚，关节屈伸不利，麻木拘挛。宜选用的成的药是
A. 舒筋活血片
B. 痛风定胶囊
C. 小活络丸
D. 活血止痛散
E. 木瓜丸

正确答案：C。小活络丸

解析：本题考查的是小活络丸的主治。患痹证多年，症见肢体关节疼痛，入夜尤甚，关节屈伸不利，麻木拘挛。宜选用的成的药是小活络丸（C对）。小活络丸：【主治】风寒湿邪痹阻、痰瘀阻络所致的痹病，症见肢体关节疼痛、或冷痛、或刺痛、或疼痛夜甚、关节屈伸不利、麻木拘挛。舒筋活血片（A错）：【主治】筋骨疼痛，肢体拘挛，腰背酸痛，跌打损伤。痛风定胶囊（B错）：【主治】湿热瘀阻所致的痹病，症见关节红肿热痛、伴有发热、汗出不解、口渴心烦、小便黄、舌红苔黄腻、脉滑数；痛风见上述证候者。活血止痛散（D错）：【主治】跌打损伤，瘀血肿痛。木瓜丸（E错）：【主治】风寒湿痹阻所致的痹病，症见关节疼痛、肿胀、屈伸不利、局部恶风寒、肢体麻木、腰膝酸软。